女，29岁。右乳红肿3个月。查体：右乳皮肤红肿，呈桔皮样改变，未触及肿块，右腋窝可触及多个肿大、质硬、融合淋巴结。皮肤活检在真皮淋巴管内查见癌栓，ER、PR阳性，C-erbB2（HER2）阴性。最可能的诊断是
A. 炎性乳腺癌
B. 黏液腺癌
C. 乳头状癌
D. 髓样癌
E. 乳头湿疹样乳腺癌

正确答案：A。炎性乳腺癌

解析：青年女性患者，右乳红肿（炎症样表现）3月。体查：右乳皮肤红肿，呈桔皮样改变（真皮水肿，提示皮下淋巴管堵塞），未触及肿块，右腋窝可触及多个肿大、质硬、融合淋巴结（提示肿瘤转移至腋窝淋巴结）。皮肤活检在真皮淋巴管内查见癌栓，ER、PR阳性，C-erbB2（HER2）阴性（提示分化欠佳）。综合该患者的病史、体查及病理学检查，最可能的诊断是炎性乳腺癌（A对）。黏液腺癌（B错）、乳头状癌（C错）及髓样癌（D错）多存在乳房内肿块，肿块质硬，表面不光滑，与周围组织分界不清，且无乳房皮肤红肿的“炎症”样表现。乳头湿疹样乳腺癌（P244）（E错）主要表现为乳头瘙痒、烧灼感，随病变发展出现乳头和乳晕皮肤粗糙，糜烂如湿疹样及溃疡，不符合该患者临床表现。